属于三级保护野生药材物种的是
A. 山茱萸
B. 金银花
C. 人参
D. 羚羊角

正确答案：A。山茱萸

解析：本题考查国家重点保护的野生药材名录。属于三级野生保护药材物种的是山茱萸（A对）。一级保护药材名称：虎骨、豹骨、羚羊角（D错）、鹿茸（梅花鹿）。二级保护药材名称：鹿茸（马鹿）、哈蟆油、金钱白花蛇、乌梢蛇、蕲蛇、蛤蚧、人参（C错）等。三级保护药材名称：川贝母（4个品种）、伊贝母（2个品种）、刺五加、黄芩、天冬、猪苓、山茱萸等。山楂、乌梅、金银花（B错）、当归等常见的中药材都被纳入按照传统既是食品又是中药材的物质目录管理。